月经周期第15～19日，为月经周期哪期
A. 分泌期
B. 分泌期早期
C. 分泌期中期
D. 分泌期晚期
E. 月经期中期

正确答案：B。分泌期早期

解析：分泌期早期：月经周期第15～19日。此期内膜腺体更长，屈曲更明显；腺上皮细胞核下开始出现含糖原小泡，称为核下空泡，为分泌期早期的组织学特征；间质水肿，螺旋小动脉继续增生、弯曲。掌握“女性生殖系统生理”知识点。